激素的第二信使不包括
A. PIP₂
B. cAMP
C. DG
D. Ca²⁺
E. IP₃

正确答案：A。PIP₂